下列诊断重度脱水的最主要依据是
A. 萎靡，烦躁
B. 皮肤、黏膜极干燥，弹性极差
C. 眼眶和前囟明显凹陷
D. 四肢稍凉
E. 尿量减少

正确答案：B。皮肤、黏膜极干燥，弹性极差

解析：本题考查儿童营养基础。重度脱水：失水量为体重的10%以上（100～120ml/kg）。精神极度萎靡，表情淡漠，口唇黏膜极度干燥，眼窝和前囟深凹，哭时无泪，皮肤弹性极差，尿量极少或无尿，休克症状。皮肤、黏膜极干燥，弹性极差（B对）。